心脏容量扩大伴收缩增强，称为
A. 紧张性扩张
B. 肌源性扩张
C. 向心性肥大
D. 心室僵硬度
E. 心肌重构

正确答案：A。紧张性扩张

解析：心衰代偿期时，心室舒张末期容积（前负荷）增加，心脏扩张，使心肌肌节初长度增大但不超过2.2μm（产生最大收缩力时的肌节长度），心肌收缩力增强，这种心脏容量扩大伴收缩增强的情况称为紧张性扩张（A对）。若长期负荷过重，心脏过度扩张，心肌肌节长度超过2.2μm，收缩力反而减弱，这种心脏容量扩大不伴收缩增强的情况称为肌源性扩张（B错）。